导致食物中毒的副溶血性弧菌最容易污染的食品是
A. 剩米饭
B. 罐头
C. 海产品和盐渍食品
D. 家庭自制豆制品
E. 禽肉类及其制品

正确答案：C。海产品和盐渍食品

解析：副溶血性弧菌主要存在于近岸海水、海底沉积物和鱼、贝类等海产品中。所以它主要污染的是海产食品，其中以墨鱼、带鱼、黄花鱼、虾、蟹、贝、海蜇最为多见，其次为盐渍食品（C对）。剩米饭易被金黄色葡萄球菌污染（A错）。罐头食品和家庭自制豆制品中易出现肉毒梭菌（BD错）。动物性食品，特别是畜肉类及其制品引起沙门菌食物中毒（E错）。